IgE的定量检测常用的简单方法是
A. 间接血凝
B. 单向免疫扩散
C. ELISA
D. 对流电泳
E. 火箭电泳

正确答案：C。ELISA

解析：酶联免疫吸附实验（ELISA）是将抗原或抗体与固相载体（如聚苯乙烯板）结合，然后加入待测抗体或抗原，最后以酶标二抗和底物进行显色的检测抗体或抗原的技术。ELISA可被用于抗原或血清抗体的定量检测。掌握“免疫学检测技术”知识点。